应慎用龙牡壮骨颗粒的是
A. 小儿脾虚证
B. 小儿实热证
C. 小儿体弱多汗
D. 小儿夜惊不宁
E. 小儿食欲不振

正确答案：B。小儿实热证

解析：本题考查的是龙牡壮骨颗粒的注意事项。龙牡壮骨颗粒为益气养阴剂，有强筋壮骨，和胃健脾的功能。但实热证者慎用（B对）。龙牡壮骨颗粒：【主治】治疗和预防小儿佝偻病、软骨病；对小儿多汗（C错）、夜惊（D错）、食欲不振（E错）、消化不良、发育迟缓也有治疗作用。【注意事项】实热证者慎用。服药期间忌食辛辣、油腻食物。患儿发热期间暂停服本品，佝偻病合并手足搐搦者应配合其他治疗。小儿脾虚证（A错）应慎用的有小儿热速清口服液、小儿化食丸、肥儿丸、清宣止咳颗粒等。